男，70岁。胆囊切除术后，第2天静脉输液中突发喘憋1小时，不能平卧。当日静脉补液量3500ml，总出量1500ml。既往陈旧性心前壁心肌梗死5年，高血压病史20年。查体：T36.5℃，BP160/60mmHg。双肺可闻及湿啰音及哮鸣音，心率97次/分，心律齐。血气分析示PaO₂60mmHg，PaCO₂35mmHg。该患者喘憋的最可能原因是
A. 急性肺水肿
B. 肺血栓栓塞
C. 再发心肌梗死
D. 气胸
E. 支气管哮喘

正确答案：A。急性肺水肿

解析：老年男性患者，术后静脉输液中突发喘憋，当日静脉补液量3500ml，总出量1500ml（容量负荷过重，心衰诱因），既往陈旧性心前壁心肌梗死5年，高血压病史20年（急性心衰病因），查体：T36.5℃，BP160/60mmHg（血压升高）。双肺可闻及湿啰音及哮鸣音（肺水肿），心率97次/分，心律齐。血气分析示PaO₂60mmHg，PaCO₂35mmHg（缺氧），根据患者病史、既往史、临床表现和体征，最可能的诊断是急性左心衰，急性肺水肿（A对）。肺血栓栓塞（PTE）（B错）常表现为呼吸困难、胸痛及咯血（P100）。气胸（D错）大多数起病急骤，病人突感一侧胸痛，针刺样或刀割样，持续时间短暂，继之胸闷和呼吸困难，可伴有刺激性咳嗽，系气体刺激胸膜所致（P120）。再发心肌梗死（C错）多表现为胸部不适，活动时心悸、气急、烦躁、心绞痛等前驱症状，病人常烦躁不安、出汗、恐惧，胸闷或有濒死感，可有有发热、心动过速、白细胞计数增高和红细胞沉降率增快等。支气管哮喘多（E错）见于青少年有过敏史，发作时双肺可闻及典型哮鸣音，咳出白色黏痰后呼吸困难常可缓解，测定血浆BNP水平对鉴别心源性和支气管性哮喘有较大的参考价值。